女性，13岁。近1年来认为自己过胖，每日专注于自己的体重、体型，严格限制每日饮食，偶有贪食情况，但饱餐之后立即自行呕吐，或服泻剂，先出现畏寒，体温偏低，月经停止，比标准体重减轻25%，经详细询问病史及各种检查既往无躯体疾病史，最可能的诊断是
A. 甲状腺功能不全
B. 癌症
C. 结核症
D. 神经性厌食症
E. 神经性贪食症

正确答案：D。神经性厌食症

解析：该病患比标准体重减轻25%（体重保持在低于正常体重的15%以上的水平 ），近1年来认为自己过胖，严格限制每日饮食，但饱餐之后立即自行呕吐，或服泻剂（有意使自己体重减轻），月经停止（内分泌障碍），既往无躯体疾病史，最可能的诊断是神经性厌食症（D对）。神经性贪食的患者表现为多食或暴食行为，体重变化不明显，与本例不符（E错）。